临床上常见的是哪一类根尖周炎
A. 急性根尖周炎浆液期
B. 急性根尖周炎化脓期
C. 根尖脓肿
D. 急性根尖周炎
E. 慢性根尖周炎

正确答案：E。慢性根尖周炎

解析：本题考查根尖周炎。急性根尖周炎可转化为慢性根尖周炎，如果不治疗将慢性炎症长期存在，所以临床上常见的根尖周炎是慢性根尖周炎（E对）。急性根尖周炎按临床表现和病理过程分为急性根尖周炎浆液期（A错）、急性根尖周炎化脓期（B错），二者在临床上均不常见，急性化脓性根尖周炎引流不畅形成根尖脓肿（C错），也不常见。慢性根尖周炎的急性发作引起急性根尖周炎，急性根尖周炎（D错）只在身体抵抗力低、细菌侵袭性强时才发生。